中西药联用得当、合理，相互为用，可取长补短，使疗效增强，病程缩短，药物的毒副作用减少。具有协同增效作用的中西药联用药组是
A. 四逆汤与地高辛
B. 磁朱丸与诺氟沙星
C. 急支糖浆与地高辛
D. 参茸片与格列本脲
E. 健胃消食片与红霉素

正确答案：A。四逆汤与地高辛

解析：本题考查的是中西药合理联用的例举。具有协同增效作用的中西药联用药组是四逆汤与地高辛（A对）。木防己汤、茯苓杏仁甘草汤、四逆汤等与强心药地高辛等联用，可以提高疗效和改善心功能不全患者的自觉症状。参茸片与格列本脲（D错）联用会降低疗效。参茸片含鹿茸，甘草、鹿茸具有糖皮质激素样作用，有水钠潴留和排钾效应，还能促进糖原异生，加速蛋白质和脂肪的分解，使甘油、乳酸等各种糖、氨基酸转化成葡萄糖，使血糖升高，从而减弱胰岛素、甲苯磺丁脲、格列本脲等降糖药的药效。磁朱丸与诺氟沙星（B错）、急支糖浆与地高辛（C错）、健胃消食片与红霉素（E错）联用的效果，2022年考试指南未明确说明。